中毒表现为咽喉发痒、麻辣、舌强流涎，甚则口腔黏膜糜烂坏死，是因
A. 服用了含轻粉的中成药
B. 服用了含马钱子的中成药
C. 服用了含蟾酥的中成药
D. 服用了含马兜铃酸成分的中成药
E. 服用了含天南星的中成药

正确答案：E。服用了含天南星的中成药